有关酶促反应动力学，哪一项是错误的
A. 底物浓度对酶促反应速率的影响呈矩形双曲线
B. 酶浓度增加，酶促反应速率增大
C. 温度对酶促反应速率的影响具有双重性
D. 酶活性受其所在环境PH的影响而有显著差异
E. 底物的分子远大于酶分子，易生成中间产物

正确答案：E。底物的分子远大于酶分子，易生成中间产物

解析：酶促反应是一个复杂的过程，生成的中间产物的酶促反应与底物浓度，酶浓度，温度，与pH值有关，与底物分子和酶分子的体积大小无关。掌握“辅酶与酶促反应”知识点。